在实验过程中将研究对象随机分为A和B两组。第一阶段，A组人群给予干预措施，B组人群为对照组，经过一段时间的干预后，两组对换，B组接受干预措施，而A组成为对照。这属于
A. 标准对照
B. 空白对照
C. 交叉对照
D. 自身对照
E. 历史对照

正确答案：C。交叉对照

解析：本题考查实验流行病学的交叉对照。在实验过程中将研究对象随机分为A和B两组。第一阶段，A组人群给予干预措施，B组人群为对照组，经过一段时间的干预后，两组对换，B组接受干预措施，而A组成为对照。这属于交叉对照（C对ABDE错）。